评价儿童生长速度最常用的指标是
A. 身高
B. 体重
C. 头围
D. 胸围
E. 腹围

正确答案：A。身高